化脓性颌骨骨髓炎病原菌最主要的是
A. 变形杆菌
B. 大肠杆菌
C. 肺炎链球菌
D. 溶血性链球菌
E. 金黄色葡萄球菌

正确答案：E。金黄色葡萄球菌

解析：化脓性颌骨骨髓炎病原菌主要为金黄色葡萄球菌，其次是溶血性链球菌，以及肺炎链球菌、大肠杆菌、变形杆菌等，其他化脓菌也可引起颌骨骨髓炎。在临床上经常看到的多是混合性细菌感染。掌握“颌骨骨髓炎”知识点。